导致AG正常型代谢性酸中毒的是
A. 严重腹泻
B. 乳酸酸中毒
C. 酮症酸中毒
D. 水杨酸中毒
E. 严重肾衰竭

正确答案：A。严重腹泻

解析：严重腹泻（A对）引起富含HC03-大量丢失引起AG正常型代谢性酸中毒。当固定酸浓度增大时才引起AG增高型代谢性酸中毒，乳酸酸中毒（B错）、酮症酸中毒（C错）、水杨酸中毒（D错）都属于固定酸增高的情况。严重肾衰竭（E错）时，体内固定酸不能由尿中排泄，固定酸含量也增高。